能补肾壮阳、温脾止泻的药是
A. 海马
B. 鹿茸
C. 淫羊藿
D. 补骨脂
E. 肉苁蓉

正确答案：D。补骨脂

解析：本题考查补骨脂的功效。能补肾壮阳、温脾止泻的药是补骨脂（D对）。补骨脂【功效】补肾壮阳，固精缩尿，温脾止泻，纳气平喘。海马（A错）【功效】补肾助阳，活血散结，消肿止痛。鹿茸（B错）【功效】壮肾阳，益精血，强筋骨，调冲任，托疮毒。淫羊藿（C错）【功效】补肾阳，强筋骨，祛风湿。肉苁蓉（E错）【功效】补肾阳，益精血，润肠通便。